肺结核的主要传播途径是
A. 吸入含结核菌的飞沫核
B. 与肺结核患者共餐
C. 与肺结核患者握手
D. 吸人含结核菌的尘埃
E. 饮用患病动物的奶产品

正确答案：A。吸入含结核菌的飞沫核

解析：本题考查肺结核的主要传播途径。肺结核的主要传播途径是吸入含结核菌的飞沫核（A对BCDE错）。肺结核病人在谈话和咳嗽时从呼吸道排出含有结核菌的飞沫，大飞沫迅速落下，小飞沫与空气接触后水分急剧蒸发形成飞沫核（微滴核），小于5μm的含菌微滴核可进入易感者肺泡造成感染。